血热瘀滞致月经不调，可用
A. 桃仁
B. 红花
C. 川芎
D. 丹参
E. 姜黄

正确答案：D。丹参

解析：以上选项均属于活血化瘀药。丹参苦，微寒；入心、肝经；主入血分，功善活血化瘀，调经止痛，祛瘀生新，为治血行不畅、瘀血阻滞之经产病的要药（D对）。桃仁苦、甘，平，可治疗瘀血阻滞之经闭痛经（A错），产后腹痛，癥瘕痞块，跌扑损伤。红花辛、温，可治疗瘀血阻滞之经闭，痛经，恶露不行（B错）。川芎辛、温，可治疗血瘀气滞，胸痹心痛，胸胁刺痛，跌扑肿痛，月经不调，经闭痛经，癥瘕腹痛，针对寒凝血瘀的月经不调（C错）。姜黄辛、苦、温，可治疗气滞血瘀、胸胁刺痛、胸痹心痛、痛经经闭、癥瘕、跌扑肿痛（E错）。